女，29岁，半小时前从高处跌落，右下肢疼痛，活动受限。查体：神志清楚，右侧大腿、小腿压痛（+），畸形，异常活动。为明确诊断，首先应进行的检查是
A. B超
B. 肌电图
C. MRI
D. X线片
E. CT

正确答案：D。X线片

解析：患者从高处跌落后，查体发现右侧大腿和小腿畸形、异常活动（骨折的特有体征，包括畸形、异常活动、骨擦音或骨擦感），考虑右下肢骨折（具有骨折特有体征之一者，即可诊断为骨折）。为明确诊断，首先应进行的检查是X线片（D对）。X线片检查对骨折的诊断和治疗具有重要价值（不仅可以显示临床上难以发现的不完全性骨折、深部的骨折、关节内骨折和小的撕脱性骨折等，还可以指导骨折的治疗）。MRI（C错）、CT（E错）对骨折的分辨率较高，主要用于早期、不典型病例、X线片难以发现及不规则骨骨折等的诊断，由于价格昂贵，一般不作为首选检查。B超（A错）无法穿透成人皮质骨，故难于诊断骨骼疾病。肌电图（B错）多用于神经肌肉损伤等疾病的诊断。